第一个上市的蛋白酪氨酸激酶抑制剂，分子中含有哌嗪环，可用于治疗费城染色体阳性的慢性粒细胞白血病和恶性胃肠道间质肿瘤的药物是
A. 吉非替尼
B. 伊马替尼
C. 阿帕替尼
D. 索拉替尼
E. 埃克替尼

正确答案：B。伊马替尼

解析：本题考查伊马替尼。第一个上市的蛋白酪氨酸激酶抑制剂，分子中含有哌嗪环，可用于治疗费城染色体阳性的慢性粒细胞白血病和恶性胃肠道间质肿瘤的药物是伊马替尼（B对）。甲磺酸伊马替尼在体内外均可在细胞水平上抑制“费城染色体”的Bcr-Abl酪氨酸激酶，能选择性抑制Bcr-Abl阳性细胞系细胞、Ph染色体阳性的慢性粒细胞白血病和急性淋巴细胞白血病病人的新鲜细胞的增殖和诱导其凋亡。此外，甲磺酸伊马替尼还可抑制血小板衍化生长因子（PDGF）受体、干细胞因子（SCF），c-Kit受体的酪氨酸激酶，从而抑制由PDGF和干细胞因子介导的细胞行为。甲磺酸伊马替尼用于治疗费城染色体阳性的慢性粒细胞白血病和恶性胃肠道间质肿瘤。吉非替尼（A错）是第一个选择性表皮生长因子受体酪氨酸激酶抑制剂，作用于ErbB-1，分子中含有3-氯-4-氟苯胺基团，用于治疗非小细胞肺癌和转移性非小细胞肺癌。阿帕替尼（C错）是国内企业研发，作用于VEGFR-2，分子中含有氰基，可用于治疗晚期胃癌的药物。索拉替尼（D错）是口服的、作用于多个激酶靶点的抗肿瘤药物，作用于RAF/PDGFR/VEGFR，用于晚期肾细胞癌的治疗，能够获得明显而持续的治疗作用；对晚期的非小细胞肺癌、肝细胞癌、黑色素瘤也有较好的疗效。埃克替尼（E错）作用于EGFR，用于局部晚期或转移的非小细胞肺癌治疗。